骨盆骨折易伤及
A. 球部尿道
B. 膜部尿道
C. 悬垂部尿道
D. 前列腺部尿道
E. 膀胱颈部

正确答案：B。膜部尿道

解析：骨盆骨折容易伤及后尿道，最易伤及尿道膜部（B对），严重时可伤及前列腺部尿道（D错）。尿道球部（A错）损伤多见于骑跨伤，悬垂部尿道（C错）和膀胱颈部（E错）损伤较少见。